囊肿属于
A. 肿瘤
B. 非真性肿瘤
C. 肿瘤液化
D. 含液体的肿瘤
E. 体液在体内的异常存积

正确答案：B。非真性肿瘤

解析：本题考查囊肿。囊肿是指非真性肿瘤（B对）。体液在体内的异常存积（E错）范围太广，比如胸水；含液体的肿瘤（D错）和肿瘤液化（C错）有肿瘤的生物学行为；囊肿为非真性肿瘤（A错），因为它没有肿瘤的转移、破坏等特点，但常具有肿瘤的某些生物学特征和临床表现。